李某，因妊娠异常需行剖宫产术，经治医师在告知孕妇丈夫手术相关信息并取得签字后实施手术。胎儿被取出后发现产妇患有双侧卵巢畸胎瘤，遂告知其丈夫并建议切除双侧卵巢。李某丈夫立即打电话与其他家属商议，医师在尚未得到家属商议结果的情况下，继续手术并切除双侧卵巢，于是发生医患纠纷。此案例中，医师侵犯的患方权利是
A. 疾病认知权
B. 知情同意权
C. 隐私保护权
D. 生命权
E. 健康权

正确答案：B。知情同意权

解析：在接受手术治疗之前，病人有权知晓自己病情及可能的治疗方案，并对医生提出的治疗方案有选择取舍的决定权。在确定采用手术治疗时，必须得到病人及其家属的真正理解和自主同意。这也是病人的基本权利。首先，保证知情；其次，征得同意；再次，签订知情同意书。未征得患者李某及其家属同意的情况下，该医生对患者实施手术治疗，违背的临床诊疗伦理原则是知情同意权（B对）。